近鼻翼基部外侧的长形凹陷为
A. 鼻面沟
B. 唇面沟
C. 颏唇沟
D. 鼻唇沟
E. 鼻小柱

正确答案：A。鼻面沟

解析：鼻面沟为近鼻翼基部外侧的长形凹陷。掌握“面部表面解剖”知识点。